某70岁女患者，因尿路感染于10天前开始服用氨苄西林。现出现腹泻。取便标本，培养出大量革兰阳性葡萄球菌。试问腹泻发生的机制是
A. 菌群失调
B. 肠毒素使腺苷环化酶活性增加
C. 细菌侵袭肠黏膜所致
D. 内毒素作用于肠黏膜
E. 肠蠕动加快

正确答案：A。菌群失调